幽门螺杆菌根除治疗方案中，常与克拉霉素和质子泵抑制剂合用的抗菌药物是
A. 哌拉西林他唑巴坦
B. 青霉素G
C. 苯唑西林
D. 苄星青霉素
E. 阿莫西林

正确答案：E。阿莫西林

解析：本题考查抗菌药物。幽门螺杆菌根除治疗方案中，常与克拉霉素和质子泵抑制剂合用的抗菌药物是阿莫西林（E对）。哌拉西林他唑巴坦（A错）适用于由耐哌拉西林、产β-内酰胺酶的金黄色葡萄球菌所致的中、重度医院获得性肺炎。青霉素G（B错）适用于革兰阳性球菌所致的感染以及破伤风、气性坏疽、流行性脑脊髓膜炎、鼠咬热、梅毒、淋病。苯唑西林（C错）治疗甲氧西林敏感金葡菌引起的肺炎。苄星青霉素（D错）用于预防风湿热、治疗各期梅毒，也可用于控制链球菌感染的流行。